女，42岁，参加宴会后突发中上腹持续性疼痛伴恶心呕吐8小时来诊，既往无胃病史。查体：T38℃，巩膜无黄染，上腹偏左有压痛及轻度肌紧张，肝浊音界正常，Murphy征阴性，肠鸣音正常。为明确诊断，首选的检查是
A. 尿淀粉酶
B. 血淀粉酶
C. 血脂肪酶
D. 腹部B超声
E. 腹部平片

正确答案：B。血淀粉酶

解析：患者中年女性，参加宴会后突发中上腹持续性疼痛伴恶心、呕吐，发热，上腹偏左有压痛及轻度肌紧张，巩膜无黄染，Murphy征阴性，患者可能的诊断为急性胰腺炎。患者发病8小时，血淀粉酶于起病后2～12小时开始增高，故为明确诊断，首选的检查是血淀粉酶（B对）。血脂肪酶起病后24～72小时开始升高，故患者发病8小时，血脂肪酶还未升高（C错）。尿淀粉酶与胰腺炎起病后12～24小时开始升高，故患者发病8小时，尿淀粉酶还未升高（A错）。腹部B超（D错）虽对急性胰腺炎诊断有一定价值，但易受胃肠气体干扰，故不常用于急性胰腺炎的诊断。腹部平片（E错）不用于急性胰腺炎的辅助检查，常用于诊断消化道穿孔、肠梗阻、骨折等疾病的辅助检查。